关于氧化磷酸化抑制剂的说法，下列说法正确的是
A. 呼吸链抑制剂能够使电子传递失去正常的控制，从而抑制氧化磷酸化过程
B. 解偶联剂能够抑制细胞呼吸，促使机体死亡
C. ATP合酶抑制剂只能够抑制氧的利用从而抑制氧化磷酸化过程
D. 解偶联剂对底物水平的磷酸化没有影响
E. 2,4-二硝基酚（DNP）属于呼吸链抑制剂

正确答案：D。解偶联剂对底物水平的磷酸化没有影响

解析：①呼吸链抑制剂：能够阻断呼吸链中某部位电子传递而使氧化磷酸化不能正常进行，此类抑制剂可使细胞呼吸停止，引起机体迅速死亡。②解偶联剂：使电子传递与ATP形成两个偶联过程分离，故称为解偶联剂，但对于底物水平的磷酸化无影响。典型的解偶联剂为2,4-二硝基酚。③ATP合酶抑制剂：抑制氧的利用也抑制ATP的形成，但不直接抑制电子传递链上的载体的作用。掌握“氧化磷酸化”知识点。